亚胺培南是
A. 含青霉烷砜结构的药物
B. 含青霉烷结构的药物
C. 含碳青霉烯结构的药物
D. 含并四苯结构的药物
E. 含内酯环结构的药物

正确答案：C。含碳青霉烯结构的药物

解析：本题考查亚胺培南。亚胺培南为碳青霉烯类，含碳青霉烯结构（C对）。含青霉烷砜结构（A错）的为青霉烷砜类抗生素。含青霉烷结构（B错）的为氧青霉烷类。含并四苯结构（D错）的为四环素类。含内酯环结构（E错）的为大环内酯类，是对红霉素C-6位羟基甲基化后得到衍生物。